在肾主闭藏的功能活动中，最具生理意义的是
A. 固摄二便，防止二便之失禁
B. 纳气归肾，促进元气之生成
C. 固摄水液，防止水液无故流失
D. 固摄精气，防止精气无故散失
E. 摄纳阳气，防止阳气浮越于上

正确答案：D。固摄精气，防止精气无故散失

解析：肾有潜藏、封藏、闭藏精气之生理特性，故又称“肾为封藏之本”。肾的封藏作用，体现在人体的藏精、纳气、固摄冲任、固摄二便等方面。肾气封藏则精气盈满，人体生机旺盛（D对）；若肾气封藏失职，则会出现滑精、喘息、遗尿，甚则小便失禁、多汗、大便滑脱不禁及女子带下、崩漏、滑胎等。固摄二便，防止二便之失禁是肾气固摄作用的体现（A错）。纳气归肾，促进元气之生成是肾主纳气作用的体现（B错）。固摄水液，防止水液无故流失是肾主水作用的体现（C错）。摄纳阳气，防止阳气浮越于上是肾藏精、肾为脏腑之本功能的体现（E错）。